治疗前列腺炎肾阳不足证，应首选
A. 金锁固精丸
B. 济生肾气丸
C. 真武汤
D. 附桂八味丸
E. 调元肾气丸

正确答案：B。济生肾气丸

解析：精浊相当于西医的前列腺炎。精浊之肾阳虚损证多见于中年人，症见排尿淋漓，腰膝酸痛，阳痿早泄，形寒肢冷，舌淡胖，苔白，脉沉细。治宜补肾助阳。方选济生肾气丸加减（B对）。金锁固精丸为固涩剂，具有固肾涩精之效，用于肾虚不固，遗精滑泄，神疲乏力，四肢酸软，腰痛耳鸣（A错）。真武汤具有温阳利水之功效，主治阳虚水泛证，可用于红蝴蝶疮之脾肾阳虚证（C错）。附桂八味丸具有温阳补肾之功，但少固精之功，同样可用于红蝴蝶疮之脾肾阳虚证（D错）。调元肾气丸可滋阴降火，益气养血，主肾阴不足证（E错）。